既能疏肝理气，又能调经止痛的药物是
A. 川楝子
B. 枳实
C. 木香
D. 香附
E. 郁金

正确答案：D。香附

解析：香附的功效是疏肝解郁，理气宽中，调经止痛（D对）。川楝子（A错）的功效是疏肝泄热，行气止痛，杀虫。枳实（B错）的功效是破气消积，化痰散痞。木香（C错）的功效是行气止痛，健脾消食。郁金（E错）的功效是活血止痛，行气解郁，清心凉血，利胆退黄。